按寸口脉分候脏腑，左关脉可候
A. 心与膻中
B. 肾与小腹
C. 脾与胃
D. 肝、胆与膈
E. 肺与胸中

正确答案：D。肝、胆与膈

解析：左关候肝胆与膈（D对）。左寸候心与膻中（A错）。左尺候肾与小腹（B错）。右关候脾与胃（C错）。右寸候肺与胸中（E错）。